下列哪项不是血厥实证的特点
A. 舌质暗红
B. 突然昏仆
C. 脉弦有力
D. 面赤唇紫
E. 头晕头痛

正确答案：E。头晕头痛

解析：血厥实者，乃肝阳上亢，阳气暴张，血随气升，气血并走于上，表现为突然昏仆（B对）、牙关紧闭、面赤唇紫（D对），或鼻衄、舌质暗红（A对）、脉弦有力（C对）。头晕头痛不是血厥实证的表现（E错，为本题正确答案）。